属于环境中的二次污染物是
A. 二手烟
B. 光化学烟雾
C. 镉
D. 二氧化碳
E. 汞

正确答案：B。光化学烟雾

解析：二次污染物：某些一次污染物进入环境后，在物理、化学或生物学作用下，或与其他物质发生反应而形成与初始污染物的理化性质和毒性完全不同的新的污染物。典型的二次污染物如一次污染物SO₂在空气中氧化成硫酸盐气溶胶，汽车排气中的氮氧化物、碳氢化合物在日光照射下发生光化学反应生成的臭氧、过氧乙酰硝酸酯、甲醛和酮类等光化学烟雾（B对）。二手烟（A错）、镉（C错）、二氧化碳（D错）、汞（E错）均不属于环境中的二次污染物。